上橄榄核叙述错误的是
A. 位于脑桥中、下部
B. 接受双侧蜗神经核纤维
C. 发出纤维加入外侧丘系
D. 参与声音的空间定位
E. 与睡眠和觉醒有关

正确答案：E。与睡眠和觉醒有关

解析：上橄榄核位于脑桥中下部（A对），此核接受双侧蜗神经核的传出纤维（B对），发出纤维加入双侧的外侧丘系（C对）。该核与蜗神经核一起，根据双耳传导声音信息的时间和强度差，共同参与声音的空间定位（D对）。与睡眠和觉醒有关（E错，为本题正确答案）的核团为蓝斑核，由去甲肾上腺素能神经元构成。